妊娠期间严重缺乏可导致孕妇营养不良性水肿的是
A. 钙
B. 碘
C. 维生素B₁
D. 维生素C
E. 叶酸

正确答案：C。维生素B₁

解析：本题考查妊娠期间严重缺乏可导致孕妇营养不良性水肿的营养素。妊娠期间严重缺乏可导致孕妇营养不良性水肿的是维生素B₁（C对ABDE错）。